环境污染的概念是
A. 排入环境中的废弃物的数量或浓度超过了环境的自净能力
B. 排入环境中的废弃物造成了环境质量下降和恶化
C. 排入环境中的废弃物影响了人体健康
D. A＋B
E. A＋B＋C

正确答案：E。A＋B＋C

解析：本题考查环境污染。环境污染是由于自然的或人为的原因，进入环境的污染物数量超过环境的自净能力，造成环境质量下降和恶化，直接或间接影响人体健康（E对ABCD错）。